下列有关动脉硬化性闭塞症临床特点的描述，错误的是
A. 病变常位于小动脉
B. 多合并高血压、高脂血症、糖尿病
C. 多见于男性
D. 一般无血栓性浅静脉炎病史
E. 发病年龄多在45岁以上

正确答案：A。病变常位于小动脉

解析：动脉硬化性闭塞症是全身性疾患，病变常位于大、中动脉（A错，为本题正确答案）。动脉硬化性闭塞症的发病年龄多在45岁以上（E对），多见于男性（C对），多合并高血压、高脂血症、糖尿病（B对）等基础疾病，一般无血栓性浅静脉炎病史（D对）。血栓闭塞性脉管炎常有血栓性浅静脉炎病史。